二类精神药品每张处方不得超过
A. 七日常用量
B. 二日常用量
C. 三日常用量
D. 二日极量
E. 三日极量

正确答案：A。七日常用量

解析：本题考查处方限量。二类精神药品每张处方不得超过7日常用量（A对）。为门（急）诊一般患者开具的麻醉药品注射剂，每张处方为一次常用量；控缓释制剂，每张处方不得超过7日常用量；其他剂型，每张处方不得超过3日常用量。第一类精神药品处方限量同麻醉药品；哌醋甲酯用于治疗儿童多动症时，每张处方不得超过15日常用量。第二类精神药品一般每张处方不得超过7日常用量；对于慢性病或某些特殊情况的患者，处方用量可以适当延长，医师应当注明理由。